下列叶酸的特性中，错误的是
A. 溶于水
B. 水溶液中易被光解破坏
C. 中性、碱性环境中对热不稳定
D. 妊娠、NSL期间需要量增加
E. 孕期缺乏可致胎儿神经管畸形

正确答案：C。中性、碱性环境中对热不稳定